受刺激可增值为颌骨囊肿和牙源肿瘤
A. 成牙骨质细胞
B. 牙周膜干细胞
C. 成骨细胞
D. 上皮剩余
E. 成纤维细胞

正确答案：D。上皮剩余

解析：本题考查牙周膜的组织结构。受刺激可增值为颌骨囊肿和牙源肿瘤的是上皮剩余（D对）。上皮剩余在牙周膜中，邻近牙骨质的纤维间隙中可见到小的上皮条索或上皮团，与牙根表面平行排列，也称 Malassez上皮剩余。这是牙根发育期上皮根鞘残留下的上皮细胞。牙骨质细胞（A错）分布在邻近牙骨质的牙周膜中，细胞扁平，胞核圆或卵圆形。细胞平铺在根面上，在牙骨质形成时近似立方状。牙周膜干细胞（B错）是存在于牙周膜中的一种未分化的间充质干细胞，具有自我更新及多向分化潜能，不仅能够维持牙周组织的稳态，而且参与牙周组织的再生成。成骨细胞（C错）同身体其他骨骼一样，在骨形成时，邻近牙槽骨表面有许多成骨细胞。形态立方状，胞核大，核仁明显，胞质嗜碱性，静止期的成骨细胞为梭形。成纤维细胞（E错）是牙周膜中数量最多、功能最重要的细胞，具有独特且高效的合成与分解胞外基质中胶原蛋白的能力。